有关栓剂质量评价及贮存的不正确表述是
A. 融变时限的测定应在37℃±1℃进行
B. 栓剂的外观应光滑、无裂缝、不起霜
C. 甘油明胶类水溶性基质应密闭、低温贮存
D. 一般的栓剂应贮存于10℃以下
E. 油脂性基质的栓剂最好在冰箱中（+2℃～-2℃）保存

正确答案：D。一般的栓剂应贮存于10℃以下